下列哪种病变引起的胸痛常沿一侧肋间神经分布
A. 胸肌劳损
B. 流行性胸痛
C. 颈椎病
D. 带状疱疹
E. 皮下蜂窝织炎

正确答案：D。带状疱疹

解析：带状疱疹（D对）是由疱疹病毒侵犯肋间神经引起的一种传染性疾病，常可导致胸痛，常见的症状是胸部一侧沿肋间神经分布的成簇水疱且伴有剧痛。胸肌劳损（A错）见于剧烈运动后导致的肌肉损伤，疼痛常常局限于损伤部位。流行性胸痛（B错）可出现胸痛、腹部肌肉剧烈疼痛，并向肩、颈部放射。颈椎病（C错）的疼痛常常局限于颈椎部位，有时可见向肩部放射。皮下蜂窝织炎（E错）时，皮肤可伴有红、肿、热、痛的改变，甚至出现功能障碍等症状。